男，32岁，因患再生障碍性贫血需要输血，当输入红细胞悬液约200毫升时，突然畏寒，发热，呕吐一次，尿呈酱油样，血压10.0/6.0kPa（75/45mmHg）。该患者最有可能是下列哪一种输血不良反应（并发症）
A. 非溶血性发热性输血反应
B. 溶血性输血反应
C. 过敏反应
D. 细菌污染反应
E. 循环超负荷

正确答案：B。溶血性输血反应

解析：患者中青年男性，输血后出现畏寒、发热、呕吐、酱油尿等症状，且血压为75/45mmHg（提示出现休克），其最可能出现的输血不良反应为溶血性输血反应（B对）。溶血反应是输血最严重的并发症，输入少量异型血即可发生，典型表现为呈酱油色的血红蛋白尿。非溶血性发热性输血反应（A错）也可表现为畏寒、发热，但血压多无变化、不出现酱油样尿；过敏反应（C错）表现为皮肤局限性和全身性瘙痒和荨麻疹，严重者可出现休克，但一般不出现畏寒、发热，无酱油样尿；细菌污染反应（D错）重者可在输入后立即出现寒战、高热、内毒素性休克和DIC，也可出现血红蛋白尿，但其发生率不高；循环超负荷（E错）常见于心功能低下、老年及幼儿，常由于输血过多或速度过快引发，表现为突发心率加快，呼吸急促，发绀或血性泡沫痰，肺水肿等。